某男，45岁。自诉经常感到头晕目眩、精神欠佳，且白发日渐增多。能治疗须发早白的药有
A. 鳖甲
B. 桑椹
C. 墨旱莲
D. 熟地黄
E. 乌梅

正确答案：B、C、D。桑椹；墨旱莲；熟地黄

解析：本题考查的是桑椹、墨旱莲、熟地黄的主治病证。某男，45岁。自诉经常感到头晕目眩、精神欠佳，且白发日渐增多。能治疗须发早白的药有桑椹（B对）、墨旱莲（C对）、熟地黄（D对）。桑椹：【主治病证】（1）阴虚血亏之眩晕、目暗、耳鸣、失眠、须发早白。（2）津伤口渴，消渴。（3）肠燥便秘。墨旱莲：【主治病证】（1）肝肾阴虚之头晕目眩、须发早白。（2）阴虚血热之吐血、衄血、尿血、便血、崩漏。熟地黄：【主治病证】（1）血虚萎黄、眩晕、心悸、月经不调、崩漏。（2）肾阴不足之潮热、盗汗、遗精，消渴。（3）精血亏虚之腰酸脚软、头晕眼花、耳聋耳鸣、须发早白。鳖甲（A错）：【主治病证】（1）阴虚阳亢之头晕目眩，热病伤阴之虚风内动。（2）阴虚发热。（3）久疟疟母，癥瘕。乌梅（E错）：【主治病证】（1）肺虚久咳。（2）久泻久痢。（3）虚热消渴。（4）蛔厥腹痛。（5）崩漏，便血。